某男，62岁。既往患风湿痹痛，筋脉拘挛，近日又见口眼㖞斜，宜选用的药物是
A. 木瓜
B. 独活
C. 穿山龙
D. 蕲蛇
E. 豨莶草

正确答案：D。蕲蛇

解析：本题考查的是蕲蛇的主治病证。既往患风湿痹痛，筋脉拘挛，近日又见口眼㖞斜，宜选用的药物是蕲蛇（D对）。蕲蛇：【主治病证】（1）风湿痹痛，筋脉拘挛。（2）中风半身不遂，口眼㖞斜，肢体麻木。（3）破伤风，急惊风，慢惊风。（4）麻风，顽癣，皮肤瘙痒。木瓜（A错）：【主治病证】（1）风湿痹痛，筋脉拘挛，脚气肿痛。（2）湿浊中阻所致吐泻转筋。（3）津亏食少（消化不良）证。独活（B错）：【主治病证】（1）风寒湿痹，腰膝酸痛。（2）表证夹湿。（3）少阴头痛，皮肤湿痒。穿山龙（C错）：【主治病证】（1）风湿痹痛，跌打伤肿。（2）咳嗽痰多。（3）闭经，疮肿。豨莶草（E错）：【主治病证】（1）风湿痹痛，肢体麻木。（2）中风手足不遂。（3）痈肿疮毒，湿疹瘙痒。（4）高血压病。